确诊宫颈癌依靠
A. 临床表现
B. 宫颈刮片细胞学检查
C. 阴道镜检查
D. 高危型人类乳头状瘤病毒检测
E. 宫颈活组织病理学检查

正确答案：E。宫颈活组织病理学检查

解析：早期宫颈癌的诊断应采用子宫颈细胞学检查（B错）和（或）高危型人类乳头状瘤病毒检测（D错）、阴道镜检查（C错）、子宫颈活组织检查的“三阶梯”程序，确诊依据为宫颈活组织病理学检查（E对）。临床表现（A错）缺乏特异性；宫颈刮片细胞学检查（P303）（B错）主要用于CIN及早期子宫颈癌筛查，也是诊断的必须步骤；阴道镜检查（P443）（C错）主要用于观察阴道和宫颈，对可疑部位行定位，均需结合活检方可确诊。